氨基苷类抗生素主要不良反应是
A. 前庭毒性
B. 耳毒性
C. 肾毒性
D. 神经肌肉阻滞
E. 以上均是

正确答案：E。以上均是